蛋白质分子三级结构的稳定因素是
A. 氢键、盐键、疏水键和二硫键
B. S形
C. 加热
D. 双曲线
E. α螺旋

正确答案：A。氢键、盐键、疏水键和二硫键